关于硝酸甘油性质和作用的说法，错误的是
A. 常温下为液体，有挥发性
B. 在遇热或撞击下易发生爆炸
C. 在碱性条件下迅速消解
D. 在体内不经代谢而排出
E. 口腔黏膜吸收迅速，心绞痛发作时，可在舌下含服

正确答案：D。在体内不经代谢而排出

解析：本题考查硝酸甘油。硝酸甘油在肝脏中经谷胱甘肽还原酶代谢，经尿和胆汁排出体外（D错，为本题正确答案）。硝酸甘油常温下为液体（A对），具有挥发性和爆炸性，在遇热或撞击下易发生爆炸（B对）；硝酸甘油在中性和弱酸性条件下相对稳定，在碱性条件下迅速水解（C对）；硝酸甘油经舌下黏膜迅速吸收，可避免肝脏对药物的首过效应，用于急性心绞痛（E对）。